某女，77岁。4月前因肺癌手术治疗，其后化疗3次。刻下面色萎黄，气短懒言，语声低微，头昏神疲，肢体无力；舌淡，边有齿痕，苔薄白，脉虚无力。宜选用的基础方剂是
A. 四物汤
B. 小建中汤
C. 桂附地黄丸
D. 四君子汤
E. 沙参麦冬汤

正确答案：D。四君子汤

解析：本题考查的是虚劳的辨证论治。某女，77岁。4月前因肺癌手术治疗，其后化疗3次。刻下面色萎黄，气短懒言，语声低微，头昏神疲，肢体无力；舌淡，边有齿痕，苔薄白，脉虚无力。宜选用的基础方剂是四君子汤（D对）。虚劳又称虚损，是以脏腑亏损、气血阴阳虚衰，久虚不复成劳为主要病机，以五脏虚证为主要临床表现的多种慢性虚弱证候的总称。西医学中多个系统的多种慢性消耗性和功能衰退性疾病，出现类似虚劳的临床表现时，可参考此内容辨证论治。（一）气虚证：【症状】面色㿠白或萎黄，气短懒言，语声低微，头昏神疲，肢体无力。舌质淡，或有齿痕，舌苔薄白，脉虚无力。【方剂应用】基础方剂为四君子汤（人参、白术、茯苓、炙甘草）加减。（二）血虚证：【症状】头晕眼花，心悸多梦，手足发麻，面色淡黄或淡白无华，口唇、爪甲色淡，妇女月经量少。舌质淡，脉细。【方剂应用】基础方剂为四物汤（A错）（熟地黄、当归、川芎、芍药）加减。（三）阴虚证：【症状】形体消瘦，口燥咽干，潮热颧红，五心烦热，盗汗，小便短黄，大便干结。舌质红，舌面少津，苔少或无苔，脉细数。【方剂应用】基础方剂为沙参麦冬汤（E错）（沙参、玉竹、生甘草、冬桑叶、麦冬、白扁豆、天花粉）加减。（四）阳虚证：【症状】畏寒怕冷，四肢不温，口淡不渴，自汗，小便清长或尿少浮肿，大便溏薄。舌体胖，舌质淡，苔白滑，脉沉迟。【方剂应用】基础方剂为附子理中汤（附子、人参、白术、甘草、干姜）加减。小建中汤（B错）与四磨汤口服液联用可用于便秘冷秘。便秘冷秘：【症状】大便艰涩，腹痛拘急，胀满拒按，胁下偏痛，手足不温，呃逆呕吐。舌苔白腻，脉弦紧。【方剂应用】基础方剂为温脾汤（附子、人参、大黄、干姜、甘草）合半硫丸（半夏、硫黄）加减。桂附地黄丸（C错）为肾虚腰痛的中成药应用。肾虚腰痛：【症状】腰部隐隐作痛，酸软无力，劳则加重，卧则减轻，或伴有耳鸣耳聋。偏于肾阴虚者，兼有手足心热，潮热盗汗，口燥咽干，舌红少苔，脉细数；偏于肾阳虚者，兼有腰部冷痛，得热则舒，肢冷畏寒，面色㿠白，舌淡胖有齿痕，脉沉细无力。【中成药应用】常用中成药有左归丸、鱼鳔丸、七宝美髯丸、腰痛片、杜仲补天素片、桂附地黄丸（水蜜丸）、济生肾气丸（水蜜丸）、杜仲颗粒。